小儿患病后易趋康复的主要原因是
A. 心常有余
B. 肝常有余
C. 稚阴稚阳
D. 脏腑已成
E. 脏气清灵

正确答案：E。脏气清灵

解析：小儿心常有余指的是小儿临床上易见心惊的病证，小儿生理上心神怯弱，病理上易感外邪，外邪易从火化，故易见火热伤心生惊（A错）。小儿肝常有余指小儿易见肝风的病证，小儿生理上肝气未盛，病理上易感外邪，外邪易从火化，故易出现火热伤肝动风的证候（B错）。小儿稚阴稚阳指的是小儿脏腑娇嫩，形气未充，故易于患病，传变迅速（C错）。小儿脏腑形气不足，功能状况不够稳定，未臻完善，故脏腑已成错误（D错）。小儿为纯阳之体，生机蓬勃，活力充足，脏气清灵，反应敏捷，修复能力极强，加之病因单纯，又少七情伤害，患病后经过及时治疗与护理，病情好转的要比成人快，且容易康复（E对）。